有关腹主动脉的描述，正确的是
A. 沿脊柱右前方下行
B. 其左侧有下腔静脉伴行
C. 胰腺跨过其前方
D. 经过十二指肠第二段后方
E. 于第3腰椎处分为左、右髂总动脉

正确答案：C。胰腺跨过其前方

解析：胰腺跨过腹主动脉的前方（C对）。腹主动脉经过十二指肠第二段前方（D错）进入肠系膜根，然后向右髂窝方向走行。